女，25岁。白带增多5天。有不洁性交史。妇科检查：小阴唇内侧及外阴部见3个菜花状赘生物。为确诊应进行的辅助检查是
A. 宫颈刮片细胞学检查
B. 赘生物活组织检查
C. 阴道分泌物培养
D. 血常规、尿常规
E. B超检查

正确答案：B。赘生物活组织检查

解析：小阴唇内侧及外阴部见菜花状赘生物，为确诊应进行的辅助检查是赘生物活组织检查（B对）。宫颈刮片细胞学检查（A错）是CIN（子宫颈上皮内瘤变）及子宫颈癌筛查的基本方法。阴道分泌物培养（C错）用于检测阴道感染及盆腔炎性疾病的病原体。血常规、尿常规（D错）为一般检查，B超检查（E错）可清晰地显示各脏器及周围器官的各种断面像，常用于检查腹腔器官病变。